中药方剂有因剂型改变而方名改变者，如传统方理中丸与人参汤两方均由干姜、白术、人参、甘草组成用量完全相同。前者制法是共为细末炼蜜为丸如鸡子黄大；后者为汤剂。通常临床所见疾病往往复杂多变，可谓病有缓急证有表里，同一中药处方可因剂型不同，作用有所差异。应根据病情的不同，选择不同的剂型给药。处方中甘草的主要成分为甘草酸其结构类型属于
A. 木脂素类
B. 三萜皂苷类
C. 甾体皂苷类
D. 生物碱类
E. 香豆素类

正确答案：B。三萜皂苷类

解析：本题考查的是甘草的化学成分。甘草的主要成分为甘草酸其结构类型属于三萜皂苷类（B对）。甘草所含的三萜皂苷以甘草皂苷含量最高。甘草皂苷又称甘草酸，为甘草中的甜味成分。《中国药典》以甘草苷和甘草酸为指标成分，控制甘草和炙甘草的质量，其中甘草苷为黄酮苷，并要求甘草和炙甘草的甘草苷含量均不得少于0.50%，甘草中甘草酸的含量不得少于2.0%，炙甘草中甘草酸的含量不得少于1.0%。木脂素类（A错）类多数是游离的，也有少量与糖结合成苷而存在，由于较广泛地存在于植物的木部和树脂中，或开始析出时呈树脂状，故称木脂素。含木脂素类化合物的常用中药有五味子、厚朴、连翘、细辛等。甾体皂苷类（C错）与三萜皂苷相似，由甾体皂苷元与糖组成。含甾体皂苷的常用中药主要有麦冬、知母等。生物碱类（D错）类主要分布于植物界，在动物界中少有发现。生物碱绝大多数存在于双子叶植物中，已知有50多个科的120多个属中存在生物碱。与中药有关的典型的科有毛茛科（黄连属黄连，乌头属乌头、附子）、防己科（汉防己、北豆根）、罂粟科（罂粟、延胡索）、茄科（曼陀罗属洋金花、颠茄属颠茄、莨菪属莨菪）、马钱科（马钱子）、小檗科（三颗针）、豆科（苦参属苦参、槐属苦豆子）等。单子叶植物也有少数科属存在生物碱，如石蒜科、百合科（贝母属的川贝母、浙贝母）、兰科等。少数裸子植物如麻黄科、红豆杉科、三尖杉科和松柏科也存在生物碱。低等植物中仅发现极个别的存在生物碱，如烟碱存在于蕨类植物中，麦角生物碱存在于菌类植物中。地衣、苔藓类植物中仅发现少数简单的吲哚类生物碱。藻类、水生类植物中未发现生物碱。香豆素类（E错）：香豆素是邻羟基桂皮酸的内酯，广泛分布于高等植物中，尤其以芸香科和伞形科为多见，少数发现于动物和微生物中。含香豆素的常用中药有秦皮、前胡、肿节风、补骨脂等。在植物体内，它们往往以游离状态或与糖结合成苷的形式存在。